在心理应激中起关键作用的因素是
A. 社会支持
B. 应对方式
C. 认知评价
D. 事件发生的可预测性
E. 事件发生的可控制性

正确答案：C。认知评价

解析：本题考查在心理应激中起关键作用的因素。在心理应激中起关键作用的因素是认知评价（C对）。社会支持（A错）是个体与社会各方面的联系程度，是应激作用过程中个体可利用的外部资源；社会支持系统好的个体倾向于比没有社会支持或很少社会支持的个体健康问题少。应对方式（B错）可以被直接理解成是个体解决生活事件和减轻事件对自身影响的各种策略，故又称为应对策略；应对是多维度的，应对活动实际上涉及应激作用过程的各个环节，包括生理反应（如烟酒药物、肌肉放松）、认知评价（如否认、自评）、情绪反应（如焦虑、发泄）、社会支持（如求助、倾诉）等层面；从应对策略与个性的关系来看，可能存在一些与个性特质有关的、相对稳定的和习惯化了的应对风格或特质应对。事件发生的可预测性（D错）、事件发生的可控制性（E错）可影响人们对应激的应对方式，减少应激对健康的影响。